正常时不明显，一旦发生炎症则可引起肿痛的是
A. 丝状乳头
B. 菌状乳头
C. 轮廓乳头
D. 叶状乳头
E. 味蕾

正确答案：D。叶状乳头

解析：叶状乳头：位于舌侧缘的后部。在人类此乳头已退化为5～8条平行的皱襞。正常时此乳头不明显，一旦发生炎症则可引起肿痛。掌握“口腔黏膜分类及组织结构”知识点。